治疗新生儿破伤风应除外
A. 保持环境安静，避免强光照射
B. 痉挛期可试用鼻饲
C. 近端用3%过氧化氢或1:4000高锰酸钾液冲洗后涂以碘伏
D. 保持呼吸道通畅
E. 脐周注射破伤风抗毒素3000单位

正确答案：B。痉挛期可试用鼻饲

解析：本题考查治疗新生儿破伤风的相关内容。在痉挛期应该暂停口鼻进食（B错，为本题正确答案），可以通过静脉供给营养，症状减轻之后才能试用胃管喂养。将患儿置于安静、避光（A对）的环境中，这样可以尽量减少刺激和痉挛的发作，保持患儿呼吸畅通（D对）。近端用3%过氧化氢或1:4000高锰酸钾液冲洗后涂以碘伏（C对），脐周注射破伤风抗毒素3000单位（E对）。